下列有关环丙沙星特点的叙述中错误的选项为
A. 对G⁻菌抗菌作用强
B. 对G⁺菌抗菌作用较青霉素G弱
C. 对绿脓杆菌、厌氧菌抗菌作用较强
D. 可用于呼吸道、泌尿道、皮肤软组织感染
E. 禁用于孕妇、哺乳期妇女及青春期前儿童

正确答案：B。对G⁺菌抗菌作用较青霉素G弱

解析：本题考查环丙沙星的特点。环丙沙星主要通过影响DNA的合成而致细菌死亡，其对革兰阳性菌的抗菌作用比青霉素G强（B错，为本题正确答案）。环丙沙星抗菌谱广，对革兰阴性杆菌（A对）抗菌作用强，对绿脓杆菌、厌氧菌抗菌（C对）作用也较强。主要用于呼吸道感染、胃肠道感染、伤寒以及皮肤软组织感染等（D对）。孕妇、哺乳期妇女及青春期前儿童应避免应用（E对）。